男，36岁，既往胆囊切除术史，两周前肛周脓肿手术史，后发现右下腹肿块4×5cm，检查方法
A. X线
B. B超
C. CT
D. 肠镜
E. CEA

正确答案：B。B超

解析：根据题干，首发症状为肛周脓肿，又发现右下腹部肿块，诊断考虑克罗恩病，题干：右下腹部肿块，首先患者刚做完肛周脓肿手术两周，不能立即行肠镜检查，同时需要排除肝胆疾病和急性阑尾炎所以首选B超（B对）。